既是淋巴器官，又有内分泌功能的是
A. 淋巴结
B. 扁桃体
C. 胸腺
D. 胰
E. 脾

正确答案：C。胸腺

解析：胸腺是T淋巴细胞分化、发育和成熟的场所，也是中枢免疫器官之一。胸腺基质细胞可产生多种细胞因子和胸腺肽类分子，可促进胸腺细胞的分化发育，也对外周的免疫器官和免疫细胞具有调节作用，故胸腺（C对）既是淋巴器官，又具有内分泌功能。淋巴结（A错）（P14）是结构最完备的外周免疫器官，是T细胞和B细胞定居的场所和免疫应答发生的场所，参与淋巴细胞再循环，具有过滤作用，但无内分泌功能。扁桃体（B错）（P17）存在于上消化道，属于外周免疫器官，内含大量弥散淋巴组织和淋巴小结，是上呼吸道的第一道免疫关卡，具有免疫功能但不具有内分泌功能。胰腺（D错）是体内重要的内分泌器官，可分泌胰岛素和胰高血糖素，但不属于免疫器官，不具有免疫功能。脾（E错）（P16）是人体最大的外周免疫器官，是机体对血源性抗原产生免疫应答的主要场所，可以可合成并分泌某些重要生物活性物质，如补体成分和细胞因子等，但无内分泌功能。